鼻咽癌病人
A. 血酸性磷酸酶升高
B. 血酸性糖蛋白升高
C. 血CEA升高
D. 血AFP升高
E. 血VCA-IgA抗体升高

正确答案：E。血VCA-IgA抗体升高

解析：鼻咽癌病人的血VCA-IgA抗体升高（E对）提示存在EB病毒感染。血酸性磷酸酶升高（A错）多见于前列腺癌以及骨肿瘤。血酸性糖蛋白升高（B错）是一种急性时相反应，人体在感染、炎症和肿瘤如肺癌等情况下会升高，对鼻咽癌没有特异性。血CEA（癌胚抗原）升高（C错）主要见于结肠癌、直肠癌、胃癌等。血AFP（甲胎蛋白）升高（D错）主要见于肝癌。